Ⅱ型强心苷的结构是
A. 苷元-（2，6-二去氧糖）
B. 苷元-（6-去氧糖甲醚）ₓ-（D-葡萄糖）y
C. 苷元-（2，6-二去氧糖）ₓ-（D-葡萄糖）y
D. 苷元-（6-去氧糖）ₓ-（D-葡萄糖）y
E. 苷元-（D-葡萄糖）y-（2，6-去氧糖）ₓ

正确答案：D。苷元-（6-去氧糖）ₓ-（D-葡萄糖）y

解析：本题考查的是强心苷糖部分与苷元的连接方式。Ⅱ型强心苷的结构是苷元-（6-去氧糖）ₓ-（D-葡萄糖）y（D对）。强心苷由强心甾苷元与不同的糖连接而成，按糖的种类及其与苷元的连接方式，将强心苷分为以下三种类型。Ⅰ型：苷元-（2，6-二去氧糖）ₓ-（D-葡萄糖）y（C错），如紫花洋地黄苷A；Ⅱ型：苷元-（6-去氧糖）ₓ-（D-葡萄糖）y，如黄夹苷甲；Ⅲ型：苷元-（D-葡萄糖）y，如绿海葱苷。